畸形中央尖常见于
A. 左右下5
B. 左右上5
C. 左右下4
D. 左右上4
E. 左右上45

正确答案：A。左右下5

解析：本题考查畸形中央尖。畸形中央尖指一般位于（牙合）面中央窝处，呈圆锥形的突起，多见于下颌前磨牙，尤以第二前磨牙最多见（A对C错），上颌前磨牙偶见（BDE错）。